土壤重金属铊污染可造成
A. 脊柱受压缩短变形，终日疼痛呼叫
B. 视野向心性缩小，感觉障碍
C. 氟斑牙
D. 黑脚病
E. 脱发（斑秃或全秃）

正确答案：E。脱发（斑秃或全秃）

解析：本题考查土壤重金属铊污染的危害。铊污染对人体的危害主要表现为：①周围神经损害，早期表现为双下肢麻木、疼痛过敏，很快出现感觉、运动障碍。②视力下降甚至失明，可见视网膜炎、球后视神经炎及视神经萎缩。③毛发脱落（E对ABCD错）。④男性还可见性欲丧失、睾丸萎缩、导致精子生成障碍等。⑤致畸和致突变性。